根分叉病变的主要致病因素
A. 牙根的解剖形态
B. 创伤
C. 菌斑
D. 牙颈部釉质突起
E. 磨牙牙髓感染经髓室底的副根管扩散到根分叉区

正确答案：C。菌斑

解析：本题考查根分叉病变的发病因素。根分叉病变是指牙周炎的病变和破坏波及了多根牙的根分叉区，在该处出现牙周袋、附着丧失和牙槽骨吸收。由于菌斑（C对）是牙周病的始动因子，菌斑的存在促进根分叉病变的发展，所以菌斑是根分叉病变的主要致病因素。牙根的解剖形态（A错）是根分叉病变的重要发病因素，根柱短根分叉区易暴露、根分叉开口大及分叉角度小器械难以进入，均是发病因素，但不是主要致病因素。创伤（B错）是牙周炎患牙的促进因素，能加速牙周炎的进展。牙颈部釉质突起（D错）处无牙周膜附着仅有结合上皮，故在牙龈有炎症时该处易形成牙周袋。磨牙牙髓感染经髓室底的副根管扩散到根分叉区（E错）常见于副根管多的多根牙，较菌斑因素少见。